从任脉开始，由内向外的经脉排列是
A. 胃经、脾经、肾经
B. 胃经、肾经、脾经
C. 肾经、脾经、胃经
D. 肾经、胃经、脾经
E. 脾经、肾经、胃经

正确答案：D。肾经、胃经、脾经

解析：任脉循行起于小腹内，沿着腹内向上经过关元等穴，到达咽喉部，循行于人体胸腹正中，而肾经循行在腹部距任脉0.5寸，在胸部距任脉为2寸；胃经循行在腹部距任脉2寸，在胸部4寸；脾经循行在腹部距任脉4寸，在胸部6寸；故从任脉开始，由内向外的经脉排列是肾经、胃经、脾经（D对）。